不是克山病心肌酶学检验指标的血清酶是
A. 磷酸肌酸激酶
B. 谷草转氨酶
C. 乳酸脱氢酶
D. 胆碱酯酶
E. 乳酸脱氢酶同工酶

正确答案：D。胆碱酯酶

解析：本题考查克山病心肌酶学检验指标的血清酶。克山病心肌酶学检验指标的血清酶有磷酸肌酸激酶（A对）、谷草转氨酶（B对）、乳酸脱氢酶（C对）、乳酸脱氢酶同工酶（E对）。胆碱酯酶（D错，为本题正确答案）不是克山病心肌酶学检验指标的血清酶。